以下哪种囊肿不属于牙源性囊肿
A. 含牙囊肿
B. 根尖周囊肿
C. 角化囊肿
D. 始基囊肿
E. 面裂囊肿

正确答案：E。面裂囊肿

解析：本题考查牙源性囊肿。面裂囊肿（E错，为本题的正确答案）是由胚胎发育过程中，残留在各个面突融合处的上皮组织演化而成，属于非牙源性囊肿。囊肿是一种非脓肿性病理性囊腔，内含囊液或半流体物质，包括颌骨囊肿和软组织囊肿，其中颌骨囊肿又可根据其组织来源不同而分为牙源性囊肿和非牙源性囊肿。牙源性囊肿是指牙形成器官的上皮或上皮剩余发生的一组囊肿，包括发育性牙源性囊肿和炎症性牙源性囊肿。发育性牙源性囊肿由牙发育和萌出过程中的某些异常所致，含牙囊肿（A对）是指发生于牙冠或牙根形成之后，在缩余釉上皮与牙冠面之间出现液体渗出而形成含牙囊肿。角化囊肿（C对）大多认为发生自牙源上皮发育异常的早期阶段——牙板及其剩余，故属于牙源性囊肿。始基囊肿（D对）是指发生于成釉器发育的早期阶段，在炎症和损伤刺激后，成釉器的星形网状层发生变性，并有液体渗出，蓄积其中而形成囊肿，属于牙源性囊肿。含牙囊肿、角化囊肿、始基囊肿属于发育性牙源性囊肿。炎症性牙源性囊肿则与颌骨内在炎症灶有关，根尖周囊肿（B对）是由于根尖肉牙肿，慢性炎症的刺激，引起牙周膜内的上皮残余增生，故属根尖周囊肿属于炎症性牙源性囊肿。